有肝脏首过效应的吸收途径是
A. 胃黏膜吸收
B. 肺黏膜吸收
C. 鼻黏膜吸收
D. 口腔黏膜吸收
E. 阴道黏膜吸收

正确答案：A。胃黏膜吸收

解析：本题考查首过效应。胃黏膜吸收（A对）有肝脏首过效应。首过效应是指口服药物在尚未吸收进入血液循环之前，在肠黏膜和肝脏被代谢而使进入血液循环的原形药量减少的现象；肺黏膜吸收（B错）是指气体、挥发性液体的药物被吸收后，可从支气管或肺泡吸收；鼻黏膜吸收（C错）药物吸收后直接进入体循环，可避免肝脏首过效应；口腔黏膜吸收（D错）是指药物经舌下静脉直接进入体循环，不经肝脏代谢，可以避免肝脏首过效应；阴道黏膜吸收（E错）：阴道血管丰富，血流经会阴静脉丛流向会阴静脉，最终进入腔静脉，可以绕过肝脏的首过效应。